男性，45岁，酗酒后8小时出现中上腹疼痛，放射至两侧腰部，伴恶心呕吐。体检腹部有压痛、肌紧张及两侧腰腹部出现蓝棕色斑，血压75/55mmHg，脉搏110次/分下列检查应首先选择
A. 血尿常规
B. 尿淀粉酶测定
C. 胸腹部X线平片
D. 血清淀粉酶测定
E. 腹部B型超声检查

正确答案：D。血清淀粉酶测定

解析：中年男性患者，酗酒后（急性胰腺炎的常见病因）8小时出现中上腹疼痛，放射至两侧腰部，伴恶心、呕吐（急性胰腺炎的典型临床表现）。体查：腹部有压痛、肌紧张（腹膜刺激征），两侧腰腹部出现蓝棕色斑（Grey-Turner征），血压75／55mmHg，脉搏110次/分（坏死性胰腺炎可出现脉速、血压下降，乃至休克）。根据患者的病史及体查，应诊断为急性胰腺炎。血清、尿淀粉酶测定（B错）是诊断胰腺炎最常用的诊断方法，淀粉酶值愈高，诊断正确率也越大。血清淀粉酶在发病后6～8小时升高，尿淀粉酶在发病后24小时方升高，该患者发病仅8小时，故首选血清淀粉酶测定（D对）。一般认为，血清淀粉酶超过500U/dL有诊断价值。血、尿常规（A错）、胸腹部X线平片（C错）对诊断急性胰腺炎没有意义。腹部B型超声检查（E错）是首选的影像学检查，但易受上腹部胃肠气体的干扰，诊断准确性欠佳。